松萝的药用部位是
A. 地衣体
B. 菌丝体
C. 菌核
D. 子实体
E. 子座

正确答案：A。地衣体

解析：本题考查的是藻、菌、地衣类中药的药用部位。松萝的药用部位是地衣体（A对）。藻、菌、地衣类中药的药用部位：1.藻类中药：药用部位为藻类植物体的中药，称为藻类中药。藻类中药主要在褐藻门和红藻门，少数在绿藻门。药用的褐藻有海藻、昆布等；药用的红藻有鹧鸪菜、海人草等；药用的绿藻有石莼及孔石莼等。2.菌类中药：药用部位主要为真菌的菌核（C错）（茯苓、猪苓、雷丸）、子实体（D错）（灵芝、马勃）或子座与幼虫尸体的复合体（冬虫夏草）的中药，称为菌类中药。3.地衣类中药：药用部位为地衣体的中药，称作地衣类中药。常用的地衣类中药如松萝。药用部位为菌丝体（B错）或子座（E错）的中药，2022年考试指南未明确说明。